小儿肾病综合征中脾肾阳虚证偏肾阳虚的首选方剂是
A. 真武汤和黄芪桂枝五物汤
B. 实脾饮
C. 右归丸
D. 六味地黄丸
E. 五苓散

正确答案：A。真武汤和黄芪桂枝五物汤

解析：肾病综合征脾肾阳虚证是由于脾肾虚弱，气化、运化功能失常，津液输布失调所致，治以温肾健脾，化气行水，偏于肾阳虚者，方药为真武汤合黄芪桂枝五物汤（A对）。实脾饮（B错）其功用为温阳健脾，行气利水，适用于脾肾阳虚之偏于脾阳虚者。右归丸（C错）其功用为温补肾阳，填精益髓，适用于肾阳不足，命门火衰证，。六味地黄丸（D错）加黄芪，其功用为益气养阴，可用于肾病综合征之气阴两虚证。五苓散（E错）其功用为利水渗湿，温阳化气，适用于膀胱气化不利之蓄水证。